下面关于儿童葡萄糖耐量下降（IGT）的说法，错误的表达是
A. 儿童（IGT）的影响因素主要是遗传
B. 儿童（IGT）的影响因素主要是肥胖和不良生活方式
C. 儿童（IGT）单纯而病程短、程度轻
D. 儿童（IGT）具有一定的可逆性
E. 儿童（IGT）应作为早期预防糖尿病的重点

正确答案：A。儿童（IGT）的影响因素主要是遗传